用于人工冬眠的药物是
A. 吗啡
B. 丙咪嗪
C. 氯丙嗪
D. 安坦
E. 左旋多巴

正确答案：C。氯丙嗪

解析：氯丙嗪（C对）为常用的复合麻醉中的降温药物，可在物理降温的基础上使用，从而使体温下降至较低水平（28℃2004U2-30℃），降低心、脑等生命器官的耗氧量，便于进行心脑血管手术。吗啡（A错）属于阿片生物碱类镇痛药，临床主要用于镇痛、心源性哮喘、咳嗽、腹泻等。丙米嗪（B错）抑制中枢神经对去甲肾上腺素和52004U2-羟色胺的再吸收，增加突触间隙中去甲肾上腺素和52004U2-羟色胺的浓度，具有较强的抗抑郁作用。安坦（D错）又名盐酸苯海索，阻断中枢胆碱能受体，减弱黑质—纹状体通路中乙酰胆碱的作用和降低网状结构—丘脑及丘脑—皮质投射系统的兴奋性，发挥抗胆碱、抗震颤作用，临床用于治疗帕金森病。左旋多巴（E错）为体内合成多巴胺的前体物质，进入脑组织的左旋多巴，经脑内AADC脱羧转化为DA，补充纹状体DA不足，产生抗帕金森病作用。